最有助于诊断肠结核的病理改变是
A. 黏膜弥漫性炎症
B. 节段性炎症
C. 匍行沟槽样溃疡
D. 干酪性肉芽肿
E. 非干酪性肉芽肿

正确答案：D。干酪性肉芽肿

解析：结核病中，最具有诊断价值的病理改变是结核肉芽肿（结核结节），典型的结核肉芽肿主要由上皮样细胞和朗汉斯巨细胞构成，中央有干酪样坏死。肠结核属于肺外结核病，故其最具有诊断价值的病理改变是干酪性肉芽肿（D对）。黏膜弥漫性炎症（A错）多见于溃疡性结肠炎（八版内科学P385）。节段性炎症（B错）、匍行沟槽样溃疡（C错）和非干酪性肉芽肿（E错）主要见于克罗恩病（八版内科学P388）。